患者，女，28岁。婚后2周突发寒战、发热、尿频、尿痛半天，来医院急诊。查体：肾区区叩击痛(+)，尿镜检白细胞增多，并见白细胞管型，尿细菌培养阳性，诊断为急性肾盂肾炎。应首先考虑的治疗是
A. 庆大霉素
B. 长效磺胺
C. 红霉素
D. 青霉素
E. 头孢菌素类抗生素

正确答案：E。头孢菌素类抗生素

解析：患者诊断为急性肾盂肾炎，且病情较轻，故常用的治疗药物有喹诺酮类、半合成青霉素类（D错）及头孢菌素类（E对）。庆大霉素（A错）属于氨基糖苷类抗生素，用于全身感染症状严重的肾盂肾炎患者。长效磺胺用于呼吸道感染、胃肠道感染等（B错）。红霉素主要用于革兰阳性杆菌感染的疾病，如婴儿肺炎、军团菌肺炎、皮肤软组织感染等（C错）。